属于不溶性骨架缓释材料的是
A. 羟苯乙酯
B. 明胶
C. 乙烯-醋酸乙烯共聚物
D. β-环糊精
E. 醋酸纤维素酞酸酯

正确答案：C。乙烯-醋酸乙烯共聚物

解析：本题考查不溶性骨架缓释材料。不溶性骨架材料是指不溶于水或水溶性极小的高分子聚合物或无毒塑料等。常用的有乙基纤维素（EC）、聚乙烯、无毒聚氯乙烯、乙烯-醋酸乙烯共聚物（C对）、硅橡胶等。羟苯乙酯（A错）是液体制剂中常用的防腐剂。明胶（B错）是液体制剂常用的增稠剂。β-环糊精（D错）是制备包合物的包合材料。醋酸纤维素酞酸酯（CAP）（E错）为肠溶性包衣材料。